一患者，右上中切牙金属烤瓷冠修复后，检查：金属烤瓷冠颜色形态良好，不松动，颈部边缘探诊可以探入冠内，邻接点牙线可以勉强通过，正中（牙合）时咬在金属烤瓷冠的瓷面上，你认为此冠
A. 合格修复体
B. 邻接过紧
C. 邻接过松
D. 金瓷结合区没计不当
E. 边缘不密合

正确答案：E。边缘不密合

解析：本题考查修复体试戴、磨光与粘固。可以咬在瓷面上，不能咬在金属和瓷衔接处。颈部边缘探诊可以探入冠内，提示边缘不密合（E对）。